下列不是吸毒的三级预防措施于二级预防的是
A. 电视教育
B. 街道宣教
C. 学校教育
D. 标语口号
E. 重返社会

正确答案：E。重返社会

解析：本题考查吸毒的三级预防。吸毒三级预防措施中的二级预防主要是通过各种措施如电视教育（A对）、街道宣教（B对）、学校教育（C对）、标语口号（D对）等预防吸毒，脱毒治疗和治疗之后的康复。重返社会（E错，为本题正确答案）不属于吸毒三级预防措施中的二级预防。